男，46岁。近1年来反复出现左鼻旁、左颊部、吃饭疼、说话疼痛，最近发作次数增多，疼痛难以忍受。起初服用卡马西平有效。但最近服药效果较差。最可能的诊断是
A. 三叉神经第Ⅰ支痛
B. 三叉神经第Ⅱ支
C. 三叉神经第Ⅰ、Ⅲ支痛
D. 三叉神经第Ⅰ、Ⅱ支痛
E. 三叉神经第Ⅱ、Ⅲ支痛

正确答案：E。三叉神经第Ⅱ、Ⅲ支痛

解析：本题考查三叉神经的分支。反复出现左鼻旁、左颊部、吃饭疼、说话疼痛，近期发作次数增多，疼痛难以忍受。起初服用卡马西平有效。但最近服药效果较差。最可能的诊断是三叉神经第Ⅱ、Ⅲ支痛（E对）。三叉神经的各分支常见“扳机点”的部位如下：（1）眼支即第Ⅰ支（ACD错）：眶上孔、上眼睑、眉、前额及颞部等部位。（2）上颌支即Ⅱ支（B错）：眶下孔、下眼睑、鼻唇沟、鼻翼、上唇、鼻孔下方或口角区、上颌结节或腭大孔等部位。（3）下颌支即第Ⅲ支：颏孔、下唇、口角区、耳屏部、颊黏膜、颊脂垫尖、舌颌沟等处，并观察在开闭口及舌运动时有无疼痛的发作。题干中提及的鼻部和颊部疼痛，符合三叉神经第Ⅱ、Ⅲ支。